引发胎儿畸形发生率明显增高的环境污染物是
A. 甲基汞
B. 反应停
C. 苯并（a）芘
D. 硫氧化物
E. 硫酸盐

正确答案：A。甲基汞

解析：本题考查引发胎儿畸形发生率明显增高的环境污染物。甲基汞可以通过食物链进入人体，并且可以通过呼吸和皮肤接触进入人体。一旦进入体内，甲基汞可以累积在人体重要器官和组织中，导致慢性中毒。当妊娠期接触甲基汞污染的母亲，甲基汞（A对BCDE错）会通过胎盘进入胎儿体内，影响胎儿的发育，导致胎儿畸形发生率明显增高。研究表明，接触高浓度甲基汞的胎儿可能出现脊椎畸形、脑部发育障碍、心脏病变、眼部畸形等畸形。